不符合水痘皮疹特点的是
A. 皮疹呈向心性分布
B. 皮疹最初形态为斑丘疹
C. 粘膜处也可见皮疹
D. 丘疹、疱疹、结痂可同时存在
E. 皮疹不伴搔痒

正确答案：E。皮疹不伴搔痒

解析：水痘皮疹特点有皮疹呈向心性分布（A对）、皮疹最初形态为斑丘疹（B对）、粘膜处也可见皮疹（C对）、丘疹疱疹结痂可同时存在（D对）、皮疹伴明显瘙痒（E错，为本题正确答案）等。